男，35岁。突发剧烈头痛伴恶心、呕吐烦躁不安1天。查体：双眼视力Ⅲ度减退，双颞侧偏盲。急诊CT示：鞍区椭圆形占位性病变3cm×2cm×2cm大小，高密度影，可见液平面，幕上脑室扩大。应采取的有效治疗措施是
A. 立即给予糖皮质激素治疗
B. 立即给予神经营养药
C. 保守治疗，病情稳定后手术治疗
D. 迅速给予镇静处理
E. 急症手术视神经减压

正确答案：E。急症手术视神经减压

解析：患者急性起病，突发剧烈头痛伴恶心、呕吐（颅内压增高症状），查体：双眼视力Ⅲ度减退双颞侧偏盲（视交叉压迫症状）。急诊CT示鞍区椭圆形占位性病变3cm×2cm×2cm大小（垂体瘤可能），高密度影，可见液平面（提示鞍区出血）：幕上脑室扩大。可初步判断考虑为垂体瘤急性瘤卒中出血。因患者已出现是神经压迫症状，符合外科手术适应证，需行急诊手术视神经减压（E对）。保守治疗，病情稳定后手术治疗（C错）会错过最佳治疗时机造成不可逆的神经损伤。手术时可同时给予镇静处理（D错）。术后可给予糖皮质激素降颅压，神经营养药进行后期治疗（AB错）。